微笑时的唇低线位于下颌中切牙的
A. 切缘
B. 切1/3
C. 切1/2
D. 切2/3
E. 龈缘

正确答案：C。切1/2

解析：本题考查微笑时的唇低线与下颌中切牙的关系。全口义齿修复时，在蜡堤上确定唇高线和唇低线以确定排牙时上下颌牙齿的高度，有利于选择高度合适的牙齿进行排牙。下唇线至牙合平面的距离为下中切牙的切1/2的长度，即下唇线位于下颌中切牙的切1/2（C对），上唇线位于上颌中切牙的切2/3，中切牙露出过多或过少会影响义齿美观。